病原体进入宿主机体，并与之相互作用的过程是
A. 传播过程
B. 传染过程
C. 传染期
D. 流行过程
E. 隔离期

正确答案：B。传染过程

解析：本题考查传染过程。病原体进入宿主机体后，与机体相互作用、相互斗争的过程是传染过程（B对ACDE错）。